对阻碍医师依法执业，侮辱诽谤威胁，殴打医师的人员进行行政处罚时，应当适用
A. 《执业医师法》
B. 《医疗机构管理条例》
C. 《医疗事故处理条例》
D. 《治安管理处罚条例》
E. 《刑法》

正确答案：D。《治安管理处罚条例》

解析：依照《医疗事故处理条例》规定，以医疗事故为由，寻衅滋事、抢夺病历资料，扰乱医疗机构正常医疗秩序和医疗事故技术鉴定工作，依法追究刑事责任；尚不够刑事处罚的，依法给予治安管理处罚。对阻碍医师依法执业，侮辱诽谤威胁，殴打医师的人员进行行政处罚时应依照《治安管理处罚条例》（D对）。题干中强调“行政处罚时”，说明尚不构成《刑法》（E错）处罚的范畴。